与传染源直接接触导致感染的疾病是
A. 流行性感冒
B. 霍乱
C. 炭疽
D. 流行性乙型脑炎
E. 乙肝

正确答案：C。炭疽

解析：本题考查传染病总论。炭疽（C对）、钩端螺旋体病等传播，是直接与传染源接触而受到感染的。